患者，女，40岁。突起呼吸困难，两肺满布以呼气相为主的哮鸣音，无湿啰音，心率100次/分，心界不大，心脏听诊无杂音，并见咳嗽，痰涎稀白，口不渴，面色晦滞带青，形寒肢冷，舌苔白滑，脉浮紧。应首先考虑的治疗药物是
A. β受体激动剂与射干麻黄汤
B. 氨茶碱与玉屏风散
C. 西地兰与六君子汤
D. 异丙肾上腺素与金匮肾气丸
E. 糖皮质激素与定喘汤

正确答案：A。β受体激动剂与射干麻黄汤

解析：根据患者呼吸困难，两肺满布以呼气相为主的哮鸣音，可以诊断为哮证；寒痰伏肺，遇感触发，痰升气阻，以致咳嗽；病因于寒，内无郁热，故见痰涎稀白，口不渴；阴寒于内，阳气不能宣达，故见面色晦滞带青，形寒肢冷；舌苔白滑，脉浮紧属发作期寒哮的特点，治疗需温肺散寒，化痰平喘，方用射干麻黄汤加减。西医可以诊断为支气管哮喘，控制急性发作期的首选药物当选ß受体激动剂（A对）。氨茶碱与玉屏风散（B错）可以补肺固卫，用于治疗肺虚证。西地兰与六君子汤（C错）可以健脾化痰，用于治疗脾虚证。异丙肾上腺素与金匮肾气丸（D错）可以补肾纳气，用于治疗肾虚证。糖皮质激素与定喘汤（E错）可以清热宣肺，化痰定喘，用于治疗热哮证。